下列哪项不是单纯性白斑的病理变化
A. 上皮表面过度角化
B. 上皮棘层增生
C. 上皮钉突增生延长
D. 上皮不典型增生
E. 上皮基底膜清晰

正确答案：D。上皮不典型增生

解析：本题考查单纯性白斑的病理变化。上皮不典型增生见于上皮异常增生的白斑，而非单纯性白斑（D错，为本题的正确答案）。单纯性白斑的主要病理改变是上皮单纯性增生，主要表现为上皮过度正角化（A对），上皮粒层明显和棘层增生（B对），上皮钉突可伸长（C对），但基底膜清晰（E对）。